血胸活动性出血的征象不包括
A. 脉快血压下降，补液后血压不升或回升后又下降
B. 血红蛋白血球压积持续降低
C. 胸片阴影逐渐增大
D. 穿刺液涂片红细胞与白细胞之比为100：1
E. 闭式引流量连续3小时，每小时超过200ml

正确答案：D。穿刺液涂片红细胞与白细胞之比为100：1

解析：血胸活动性出血的征象包括：①脉快血压下降，补液后血压不升或回升后又下降（A对）；②血红蛋白血球压积（即血细胞比容）持续降低（B对）；③闭式引流量连续3小时，每小时超过200ml（E对）。血胸活动性出血时，X线检查可见胸内阴影进行性增大（C对）。胸腔穿刺液涂片红细胞与白细胞之比达100：1（D错，为本题正确答案）为感染性血胸（P251）的表现。